强迫症的核心症状
A. 强迫行为
B. 强迫意向
C. 强迫表象
D. 强迫性恐惧
E. 强迫意念

正确答案：E。强迫意念

解析：强迫症基本症状为强迫观念和强迫行为，其中以强迫观念为核心症状，最为常见（E对）。强迫动作是一再出现的重复或刻板的行为，常继发于强迫观念，不是强迫症的核心症状（A错）。强迫意向是强迫观念的症状之一，不是强迫症的核心症状（B错）。